下列符合梗阻性肥厚型心肌病的重要诊断是
A. 一过性晕厥和黑曚不适
B. 心电图提示左室高电压与T波倒置，有病理性Q波
C. 感胸闷不适
D. 超声心动图示舒张期室间隔与左室后壁厚度之比>1.5，二尖瓣前叶收缩期向前运动
E. 可闻及胸骨左缘2～4肋间舒张期杂音

正确答案：D。超声心动图示舒张期室间隔与左室后壁厚度之比>1.5，二尖瓣前叶收缩期向前运动

解析：梗阻性肥厚型心肌病的重要诊断是超声心动图，它显示心室不对称肥厚而无心室腔增大为其特征。舒张期室间隔厚度达15mm。伴有流出道梗阻的病例可见室间隔流出道部分向左心室内突出、二尖瓣前叶在收缩期前移(SAM) 、左心室顺应性降低致舒张功能障碍等（D对）。